功能开窍醒神的药物是
A. 麝香
B. 冰片
C. 两者均是
D. 两者均不是

正确答案：C。两者均是

解析：本题考查的是麝香与冰片的功效。功能开窍醒神的药物是麝香与冰片（C对）。麝香（A错）：【功效】开窍醒神，活血通经，消肿止痛。冰片（B错）：【功效】开窍醒神，清热止痛。